患者经期小腹胀痛拒按，胸胁乳房胀痛，经行不畅，月经色紫黯、有块，舌质紫暗，脉弦。治疗应选用
A. 肉桂
B. 艾叶
C. 牡丹皮
D. 川芎
E. 青皮

正确答案：D。川芎

解析：患者经期小腹胀痛拒按，胸胁乳房胀痛，经行不畅，月经色紫黯、有块，舌质紫暗，脉弦，为血瘀气滞痛症，治以行气止痛，活血化瘀。川芎具有活血行气，祛风止痛的功效,川芎为妇科要药，既能活血调经，又能行气止痛，为“血中之气药”，可治气滞血瘀诸痛（D对）。肉桂为温里药，具有补火助阳，散寒止痛，温经止痛，引火归原的功效，可治寒邪内侵或脾胃虚寒的脘腹冷痛及寒痹腰痛，没有活血行气的功能（A错）。艾叶为温经止血药，可止冷痛，为治妇科下焦虚寒或寒客胞宫之要药，没有活血行气的功能（B错）。牡丹皮为清热凉血药，没有活血行气的功能（C错）。青皮具有疏肝破气，消积化滞的功效，治脘腹胀痛、冷痛和食积腹痛，没有活血行气的功能（E错）。